最常导致肝硬化的DNA病毒
A. HAV
B. HBV
C. HCV
D. HDV
E. HEV

正确答案：B。HBV

解析：最常导致肝硬化的病毒是HBV（乙型肝炎病毒）（B对），其次为HCV（丙型肝炎病毒）（C错），HDV（丁型肝炎病毒）（D错）需和HBV一起存在时才发展为肝硬化。甲型肝炎病毒（HAV）（A错）和戊型肝炎病毒（HEV）（E错）感染所致肝炎一般不发展为肝硬化。并且以上病毒除乙型肝炎病毒为DNA病毒外，其余均为RNA病毒。